通过病例报告可实现的研究目的是
A. 为了早发现、早诊断、早治疗宫颈癌
B. 对个别发生的麻疹患者进行调查
C. 烟草消耗量与肺癌的关系研究
D. 对临床诊疗过程中遇见的某罕见疾病病例的临床表现、治疗与转归等进行描述
E. 为了获取某地高校学生的乙肝感染率

正确答案：D。对临床诊疗过程中遇见的某罕见疾病病例的临床表现、治疗与转归等进行描述

解析：本题考查病例报告的目的。病例报告是对临床上某种罕见病的单个病例或少数病例的详细介绍，可实现对临床诊疗过程中遇见的某罕见疾病病例的临床表现、治疗与转归等进行描述（D对ABCE错）。